属于β受体阻滞剂类降压药的是
A. 贝那普利
B. 硝酸甘油
C. 地高辛
D. 普萘洛尔
E. 地尔硫䓬

正确答案：D。普萘洛尔

解析：β受体阻滞剂类降压药包括普萘洛尔（D对）、阿替洛尔、拉贝洛尔、卡维洛尔。贝那普利（A错）属于ACEI类降压药。硝酸甘油（B错）属于血管平滑肌扩张类降压药。地尔硫䓬（E错）属于钙通道受体阻滞剂类降压药。地高辛（C错）属于正性肌力药，不属于降压药。